与阿苯达唑相符的叙述是
A. 有旋光性，临床应用其左旋体
B. 易溶于水和乙醇
C. 有免疫调节作用的广谱驱虫药
D. 含苯并咪唑环的广谱高效驱虫药
E. 不含硫原子的广谱高效驱虫药

正确答案：D。含苯并咪唑环的广谱高效驱虫药

解析：本题考查阿苯达唑。阿苯达唑是对四咪唑衍生物研究后所得的广谱驱虫药，即保留四咪唑分子中的咪唑环，将氢化噻唑环打开，得到的苯并咪唑类药物，有旋光性，临床应用其左旋体（D对）；阿苯达唑无手性中心（A错）；结构中含有硫醚片段（E错）；在乙醇和水中几乎不溶（B错）；驱虫药中有免疫调节作用的为左旋咪唑，阿苯达唑无免疫调节作用（C错）。